对于子宫的说法，正确的是
A. 为壁厚，腔大的肌性器官
B. 位于直肠与膀胱之间
C. 借子宫阔韧带固定于骶骨前面
D. 子宫颈管外口，未产妇为横裂状
E. 为腹膜外位器官

正确答案：B。位于直肠与膀胱之间

解析：子宫是壁厚，腔小（A错）的肌性器官，位于直肠与膀胱之间（B对），子宫借子宫阔韧带固定于盆侧壁和盆底（C错），子宫颈管外口，未产妇为圆形（D错），己产妇子宫口为横裂状，子宫表面大部分被腹膜所覆盖，所以子宫为腹膜外位器官（E错）。